某栓剂空白栓重2.0g，含药栓重2.075g，含药量为0.2g，其置换价是
A. 1.6
B. 1.5
C. 1.4
D. 1.3
E. 1.2

正确答案：A。1.6

解析：本题考查置换价的计算。置换价是指药物的重量与同体积基质重量的比值。计算公式为：f= W/[G-(M-W)]式中，W：每粒栓剂中主药的含量；G：每粒纯基质栓剂的重量；M：每粒含药栓剂的重量。则：0.2/[2.0-（2.075-0.2）=1.6（A对）。